诊断小肠病按诊常用的腧穴是
A. 关元
B. 气海
C. 悬钟
D. 手三里
E. 外关

正确答案：A。关元

解析：小肠病按诊常用腧穴为关元（A对）。气海为肾病常用腧穴（B错）。悬钟为胆经腧穴，可反映胆病（C错）。手三里为大肠经腧穴，可反映大肠病（D错）。外关为三焦经腧穴，可反映三焦病（E错）。